法洛四联症心脏杂音响度主要取决于
A. 左右室之间压力差
B. 肺动脉瓣狭窄程度
C. 室间隔缺损大小
D. 主动脉骑跨程度
E. 右室肥厚程度

正确答案：B。肺动脉瓣狭窄程度

解析：法洛四联症心脏杂音表现为胸骨左缘第2-4肋间可闻及Ⅱ-Ⅲ级粗糙喷射性收缩期杂音，是由右心室流出道梗阻（B对）所致。因室间隔缺损大小（C错）为非限制性，左右室之间压力差（A错）基本为零，在此基础上，根据肺动脉狭窄程度，出现左向右或右向左分流，均不是影响心脏杂音响度主要因素。主动脉骑跨程度（D错）是患儿出现青紫的病因，不是影响心脏杂音响度主要因素。右室肥厚是因右心室流出道梗阻，导致右心室后负荷加重所引起的代偿性肥厚，不是影响心脏杂音响度主要因素（E错）。